冠状窦内静脉血入
A. 左心房
B. 右心房
C. 右心室
D. 左心室
E. 房室交界点

正确答案：B。右心房

解析：右心房（B对）为冠状窦内静脉血的注入部位，其后部还有上腔静脉和下腔静脉的开口。